女，26岁。1型糖尿病。采用强化胰岛素治疗方案，夜间血糖控制良好，无低血糖发生，但清晨空腹血糖仍然较高。原因可能是
A. 糖耐量减低
B. 黎明现象
C. Somogyi现象
D. 反应性高血糖
E. 夜间胰岛素作用不足

正确答案：B。黎明现象

解析：采用替代胰岛素治疗方案后，有时早晨空腹血糖仍然较高，可能的原因有三种，分别是夜间胰岛素不足、“黎明现象”和Somogyj效应（AD错），因本患者夜间血糖控制良好（E错），无低血糖发生，故原因是“黎明现象”（B对）。Somogyi效应（C错）指的是即在夜间曾有低血糖，在睡眠中未被察觉，但导致体内胰岛素拮抗激素分泌增加，继而发生低血糖后的反跳性高血糖。